最大无作用剂量（未观察到有害作用水平）是
A. 未能观察到任何对机体损害作用的最低剂量
B. 未能观察到任何对机体损害作用的最高剂量
C. 人类终身摄入该化合物未能引起任何损害作用的剂量
D. 一种化学物在环境中存在而不引起物体的损害的剂量

正确答案：B。未能观察到任何对机体损害作用的最高剂量

解析：本题考查最大无作用剂量（未观察到有害作用水平）。最大无作用剂量（未观察到有害作用水平）是未能观察到任何对机体损害作用的最高剂量（B对ACD错）。